穿心莲的有效成分
A. 生物碱
B. 蒽醌
C. 苷类
D. 二萜内酯
E. 香豆素

正确答案：D。二萜内酯

解析：本题考查的是穿心莲的主要成分。穿心莲的有效成分二萜内酯（D对）。穿心莲叶中含有多种二萜内酯及二萜内酯苷类成分，如穿心莲内酯、新穿心莲内酯、14-去氧穿心莲内酯、脱水穿心莲内酯等。其中穿心莲内酯含量最高，为其主要活性成分。有机胺类生物碱（A错）的结构特点是氮原子不在环状结构内，如麻黄中的麻黄碱，秋水仙中的秋水仙碱，益母草中的益母草碱等。芦荟中主要活性成分是羟基蒽醌（B错）类衍生物，包括芦荟大黄素、大黄酸、大黄素、大黄酚、大黄素甲醚等。苷类（C错）又称配糖体，是糖或糖的衍生物如氨基糖、糖醛酸等与另一非糖物质通过糖的端基碳原子连接而成的化合物。苷类多是固体，其中糖基少的可为结晶，糖基多的如皂苷，则多为具吸湿性的无定形粉末。异香豆素是香豆素（E错）的异构体，在植物中存在的多数为二氢异香豆素的衍生物，其代表化合物如茵陈炔内酯、仙鹤草内酯等。